普查的目的不包括
A. 早期发现和治疗病人
B. 了解疾病的分布
C. 了解健康状况的分布
D. 适用于患病率低的疾病的研究
E. 确定人体的正常生理指标

正确答案：D。适用于患病率低的疾病的研究

解析：本题考查普查的目的。普查的目的主要包括：①早期发现、早期诊断和早期治疗病人（A对）；②了解慢性病的患病及急性传染性疾病的疫情分布（B对）；③了解当地居民健康水平（C对）；④了解人体各类生理生化指标的正常值范围（E对）。普查不适用于患病率低的疾病的研究（D错，为本题正确答案）。